患者，男，60岁，诊断为高血压伴高尿酸血症，首选的药物是
A. 维拉帕米
B. 氯沙坦
C. 螺内酯
D. 美托洛尔
E. 多沙唑嗪

正确答案：B。氯沙坦

解析：本题考查氯沙坦。高血压伴高尿酸血症，首选的药物是氯沙坦（B对）。血管紧张素Ⅱ受体拮抗剂(如氯沙坦）兼具降压和降尿酸。维拉帕米（A错）为钙通道阻滞剂，用于心绞痛、心律失常、原发性高血压等。螺内酯（C错）为保钾利尿药，用于水肿性疾病、高血压、原发性醛固酮增多症、低钾血症的预防。美托洛尔（D错）属于β-受体阻断剂，适用于伴快速型心律失常、冠心病、慢性心力衰竭、交感神经活性增高、高动力状态的高血压。多沙唑嗪（E错）用于原发性轻、中高血压。